相当于细胞核的功能，决定细菌的生物学性状和遗传特征的是
A. 核质
B. 质粒
C. 核糖体
D. 肽聚糖
E. 胞质颗粒

正确答案：A。核质

解析：核质又称拟核，由裸露的双链DNA盘绕成松散的网状结构与RNA构成，无组蛋白包绕。它相当于细胞核的功能，决定细菌的生物学性状和遗传特征。掌握“细菌的大小、形态和基本结构”知识点。